首选青霉素治疗的是
A. 伤寒
B. 乙脑
C. 流感
D. 流脑
E. 霍乱

正确答案：D。流脑

解析：目前青霉素对脑膜炎球菌仍高度敏感，国内偶有耐药报道。青霉素不易透过血脑屏障，但加大剂量能在脑脊液中达到治疗有效浓度。流脑治疗首选青霉素（D对）。伤寒首选氟喹诺酮类，如氧氟沙星等（A错）。